下述糖异生的生理意义中哪一项是错误的
A. 维持血糖浓度恒定
B. 补充肝糖原
C. 调节酸碱平衡
D. 防止乳酸酸中毒
E. 蛋白质合成加强

正确答案：E。蛋白质合成加强

解析：糖异生的生理意义中不包括有蛋白质合成加强的内容。糖异生作用最重要的生理意义：①在空腹或饥饿情况下保持血糖浓度的相对恒定。体内某些组织如脑组织不能利用脂肪酸，主要依靠葡萄糖供给能量。成熟红细胞没有线粒体。完全通过糖酵解获得能量。在不进食的情况下，机体靠肝糖原的分解维持血糖浓度，但肝糖原不到12小时即消耗殆尽，此后机体主要靠糖异生维持血糖浓度的相对恒定。因此，在空腹或饥饿情况下，糖异生作用对保障大脑等重要组织器官的能量供应具有重要意义。②糖异生作用也有利于乳酸的利用。③长期禁食后，肾的糖异生作用增强，可能是由于饥饿导致代谢性酸中毒造成的。体液PH降低可促进肾小管中磷酸烯醇式丙酮酸羧激酶的合成，从而使糖异生作用增强。当肾中α-酮戊二酸因异生成糖而减少时，可促进谷氨酰胺脱氨生成谷氨酸以及谷氨酸的脱氨反应。肾小管细胞将NH3分泌入管腔中与原尿中的H+结合，有利于排氢保钠作用的进行。因而对于防止酸中毒，调节机体酸碱平衡有重要作用。掌握“糖原与糖异生”知识点。